年轻恒牙根折后治疗原则中错误的是
A. 断端复位，固定患牙
B. 一般固定2～3个月
C. 消除咬合创伤
D. 根尖1/3折断需拔除患牙
E. 定期复查，观察牙髓状况

正确答案：D。根尖1/3折断需拔除患牙

解析：治疗原则：断端复位，固定患牙，一般固定2～3个月。消除咬合创伤。术后定期复查，如果出现牙髓症状，进行根管治疗。根尖1/3折断可不予处理，但应密切观察牙髓变化和根折愈合情况。掌握“年轻恒牙外伤”知识点。